中药饮片处方书写的单位是
A. 毫克（mg）
B. 微克（μg）
C. 毫升（ml）
D. 单位（U）
E. 克（g）

正确答案：E。克（g）

解析：药品剂量与数量用阿拉伯数字书写。剂量应当使用法定剂量单位：重量以克（g）、毫克（mg）、微克（μg）、纳克（ng）为单位；容量以升（L）、毫升（ml）为单位；国际单位（IU）、单位（U）；中药饮片以克（g）为单位。掌握“处方管理概述及一般规定、处方权”知识点。